与可摘局部义齿相比，下列哪项不是固定义齿的优点
A. （牙合）力由基牙承担
B. 咀嚼效能高
C. 磨牙少
D. 近似真牙
E. 异物感小

正确答案：C。磨牙少

解析：固定义齿与可摘局部义齿相比，磨除的牙体组织较多，因此C不是它的优点。掌握“固定桥的适应证与禁忌证”知识点。